（131～132题共用题干）男，25岁。右胫前红肿2天，畏寒、发热1天。局部表皮发红，微隆起，指压稍褪色，边界清，右腹股沟淋巴结肿痛。目前最主要的处理措施是
A. 理疗
B. 局部抗生素湿敷
C. 限制活动
D. 青霉素静脉滴注
E. 切开引流

正确答案：D。青霉素静脉滴注

解析：该患者右胫前红肿2天，畏寒、发热1天。局部表皮发红，右腹股沟淋巴结肿痛（畏寒、发热、附近淋巴结常肿大、有触痛为丹毒的早期表现）。综合患者病史、症状、体征，应诊断为丹毒。丹毒最主要的治疗是应用抗菌药物，所以应该青霉素静脉滴注（D对）。理疗（A错）、局部抗生素湿敷（B错）、限制活动（C错）均为丹毒的治疗措施，但最主要的是应用抗生素。丹毒不需要切开引流（E错）。